地方性砷中毒常见的临床症状为
A. 全身皮肤瘙痒
B. 皮肤色素缺失或高度沉着
C. 恶心、呕吐、全身不适
D. 骨质疏松
E. 心脏肥大

正确答案：B。皮肤色素缺失或高度沉着

解析：本题考查慢性砷中毒常见的临床症状。地方性砷中毒是由于长期自饮用水、室内煤烟、食物等环境介质中摄入过量的砷而引起的一种生物地球化学性疾病。临床上以末梢神经炎、皮肤色素代谢异常（B对ACDE错）、掌跖部皮肤角化、肢端缺血坏疽、皮肤癌变为主要表现，是一种伴有多系统、多脏器受损的慢性全身性疾病。